属于省级药品监督管理部门直属机构的是
A. 国务院药品监督管理部门
B. 省、自治区、直辖市药品监督管理部门
C. 设区的市级药品监督管理机构
D. 药品监督管理分局
E. 药品检验机构

正确答案：C。设区的市级药品监督管理机构